当四格表的周边合计数不变时，若某格的实际频数有变化，则其相应的理论频数
A. 增大
B. 减小
C. 不变
D. 不确定
E. 随该格实际频数的增减而增减

正确答案：C。不变